静脉滴注给药达到稳态血药浓度99%所需半衰期的个数为
A. 8
B. 6.64
C. 5
D. 32
E. 1

正确答案：B。6.64

解析：本题考查静脉滴注给药。静脉滴注给药达到稳态血药浓度99%所需半衰期为6.64个（B对）；静脉滴注给药达到稳态血药浓度的百分数与半衰期之间的关系式为：n=-3.32lg（1-fss），fss为达坪分数，n表示半衰期个数，代入99%即可求得半衰期为6.64个。